根治术后5年生存率为30%的是
A. 脾曲结肠癌，DukesC期
B. 乙状结肠癌，DukesA1期
C. 横结肠癌，DukesA2期
D. 乙状结肠癌，DukesD期
E. 降结肠癌，DukesB期

正确答案：A。脾曲结肠癌，DukesC期

解析：结肠癌的预后较好，经根治手术治疗后，DukesA、B及C期的5年生存率分别可达80%、65%及30%。脾曲结肠癌属于结肠癌，经根治手术治疗后，Duks C期的5年生存率为30％（A对）。